某农村曾用飞机喷洒农药以扑杀棉花害虫，事后不久，在这数十平方公里受到该农药污染的环境里，有少数人群出现鼻刺激、咳嗽、头晕、恶心，附近村民8人发生急性中毒（有多汗、呕吐、瞳孔缩小等症状）而入院治疗，住院者中5人系同家族亲属，另3人情况不明。在上述同一污染环境中，人群之间的健康危害效应出现如此大的差异，其最大可能原因是
A. 个体接受农药的量不同
B. 身体健康状况不同
C. 个体营养状况有差异
D. 个体年龄不同
E. 个体易感性不同（某些个体存在该有害因素的易感基因）

正确答案：E。个体易感性不同（某些个体存在该有害因素的易感基因）